地黄在炮制及放置过程中容易变黑的原因是
A. 其化学成分中含有人参二醇苷
B. 其化学成分中含有强心苷
C. 其化学成分中含有环烯醚萜苷
D. 其化学成分中含有人参三醇苷
E. 其化学成分中含有洋地黄毒苷

正确答案：C。其化学成分中含有环烯醚萜苷

解析：本题考查地黄的化学成分。地黄在炮制及放置过程中容易变黑的原因是其化学成分中含有环烯醚萜苷（C对）。环烯醚萜苷易被水解，生成的苷元为半缩醛结构，其化学性质活泼，容易进一步发生氧化聚合等反应，难以得到结晶性苷元，同时使颜色变深。地黄主含环烯醚菇、单萜及其苷类化合物，还含有苯乙醇苷类、糖类、氨基酸、有机酸及无机元素等成分。人参含有皂苷、多糖和挥发油等多种化学成分，人参皂苷为人参的主要有效成分之一。人参皂苷可以分为三类，分别是人参皂苷二醇型（A对）（A型）、人参皂苷三醇型（D错）（B型）和齐墩果烷型（C型）。香加皮中含有的强心苷（B错）类化合物为甲型强心苷，其中杠柳毒苷和杠柳次苷为其主要成分。毛花洋地黄化学成分：毛花洋地黄叶中含强心苷40余种，主要有毛花洋地黄苷甲、乙、丙、丁、戊和洋地黄毒苷（E错）、羟基洋地黄毒苷、吉它洛苷等。